9岁男孩。午餐时突发神志丧失，手中持碗失落，碗打碎后即醒。脑电图示3周/秒棘慢波规律性和对称性发放。最可能的诊断是
A. 癫痫复杂部分发作
B. 癫痫部分性发作
C. 杰克逊（Jackson）癫痫
D. 癫痫失神发作
E. 不能分类的癫痫发作

正确答案：D。癫痫失神发作

解析：癫痫失神发作多为儿童期起病，青春期前停止发作，表现为是突然短暂的（5～10s）意识丧失和正在进行的动作中断，伴有失张力（手中持物坠落），发作后立即清醒，脑电图呈双侧对称3Hz棘-慢综合波。本例患者症状表现符合癫痫失神发作（D对）。癫痫复杂部分发作（A错）表现为意识障碍和自动症或仅有意识障碍。癫痫部分性发作（B错）多表现为身体某一局部发生不自主抽动或一侧肢体麻木感和针刺感，多发生在口角、舌、手指或足趾。杰克逊（Jackson）癫痫（C错）表现抽搐自手指-腕部-前臂-肘-肩-口角-面部逐渐发展（P302）。癫痫失神发作属于全面性发作，不属于不能分类的癫痫发作（E错）。